苯海拉明产生中枢抑制作用的原因是
A. 不易透过血脑屏障
B. 多数可通过血脑屏障
C. 中枢H1受体被阻断
D. 胎盘屏障
E. 以上均不正确

正确答案：C。中枢H1受体被阻断

解析：氯苯那敏类药物多数可通过血脑屏障，可有不同程度的中枢抑制作用，尤以第一代药物苯海拉明和异丙嗪为甚，表现有镇静、嗜睡。中枢抑制作用产生的原因，可能是由于中枢H1受体被阻断，拮抗了脑内源性组胺介导的觉醒反应之故。第二代药物阿司咪唑不易透过血脑屏障，故无中枢抑制作用；阿伐斯汀、左卡巴斯汀、咪唑斯汀等均无镇静、嗜睡的副作用。掌握“H1、H2受体阻断剂”知识点。